关于胸膜腔负压生理意义的叙述，错误的是
A. 保持肺的扩张状态
B. 有利于静脉回流
C. 维持正常肺通气
D. 使中央静脉压升高
E. 胸膜腔负压消失可导致肺塌陷

正确答案：D。使中央静脉压升高

解析：胸膜腔内保持负压具有重要意义：①它能保持肺的扩张状态（A对），维持正常肺通气（C对），当胸膜腔负压消失可导致肺塌陷（E对）；②它还能加大胸腔内腔静脉和胸导管的跨壁压，使静脉和胸导管扩张，有利于静脉血（B对）和淋巴液的回流。吸气时，胸腔容积加大，胸膜腔负压增大，使胸腔内的大静脉和右心房更加扩张，从而有利于外周静脉血液回流至右心房，使中心静脉压升高；呼气时，胸膜腔负压减小，则静脉回心血量相应减少，使中心静脉压降低（D错，为本题正确答案）。